借助于牙齿硬组织表面处理和粘接系统的作用，使材料与牙齿硬组织连接的方法，称为
A. 牙髓失活术
B. 牙体充填术
C. 牙体切割术
D. 牙体镶嵌修复术
E. 牙体粘接修复术

正确答案：E。牙体粘接修复术

解析：借助于牙齿硬组织表面处理和粘接系统的作用，使材料与牙齿硬组织连接的方法，称为牙体粘接修复术。掌握“树脂粘结概念及釉质、牙本质粘结”知识点。